女，28岁。己婚，因消瘦、乏力、多食，心悸3个月就诊，近2年来应用口服避孕药。下述哪项体征最有诊断意义
A. 心动过速
B. 双手震颤
C. 双眼裂增宽
D. 皮肤潮湿
E. 甲状腺Ⅱ°肿大，双上极可闻及血管杂音

正确答案：E。甲状腺Ⅱ°肿大，双上极可闻及血管杂音

解析：青年女性患者（Graves病好发人群），有口服避孕药史（Graves病的诱因），出现消瘦，乏力，多食（高代谢症候群）及心悸（交感神经系统兴奋性增强），考虑诊断为Graves病引起的甲亢。甲亢的诊断包括三点：①高代谢症状和体征；②甲状腺肿大；③血清TT₄、FT₄增高，TSH减低。甲状腺上、下极闻及血管杂音为Graves病较特异的体征，其出现对Graves病有提示作用。因此甲状腺Ⅱ°肿大，双上极可闻及血管杂音（E对）为本例最有意义的体征。心动过速（A错）、双手震颤（B错）、皮肤潮湿（D错）、双眼裂增宽（P681）（C错）仅提示血清甲状腺激素过多，无特异性。